患者，男,60岁，反复胃脘部疼痛10年，现症：胃脘疼痛，如针刺，痛有定数。按之痛苦，痛时持久，食后加剧，入夜尤甚，舌质紫黯，脉涩，治疗应首选的方剂是
A. 血府逐瘀汤
B. 桃仁红花煎
C. 隔下逐瘀汤
D. 失笑散合丹参饮
E. 桃红四物汤

正确答案：D。失笑散合丹参饮

解析：患者为胃痛病，瘀血疼胃证，用失笑散合丹参饮，前方（五灵脂、蒲黄）活血行瘀，散结止痛，治血瘀内阻之胃痛。后方（丹参、檀香、砂仁）调气化瘀，治胃痛因气滞血瘀所致者（D对），血府逐瘀汤治疗胸中血瘀证（A错），桃仁红花煎（红花、当归、桃仁、香附、延胡索、赤芍、川芎、乳香、丹参、青皮、生地）主治妇人月水不通，属瘀血者，小腹时时作痛，或少腹板急，或心脉痹阻证（B错）。膈下逐瘀汤善治膈下瘀血（C错）桃红四物汤活血补血不专于胃脘部瘀血（E错）。